色甘酸钠的作用机制是
A. 能对抗胆碱等过敏介质的作用
B. 直接松弛支气管平滑肌
C. 抑制肥大细胞脱颗粒反应
D. 促进儿茶酚胺释放
E. 阻断M受体

正确答案：C。抑制肥大细胞脱颗粒反应

解析：色甘酸钠无扩张气道的作用，但是可以稳定肥大细胞膜，减少肺肥大细胞由抗原诱发的脱颗粒反应从而使过敏介质释放；还可以抑制气道感觉神经末梢功能敏感与气道神经源性炎症引起的支气管痉挛；亦可阻断炎症细胞介导的反应，长期应用可减轻气道高反应性。掌握“平喘药”知识点。